调制奶粉与普通奶粉相比，没有增加的是
A. 乳糖
B. 亚油酸
C. 乳清蛋白
D. Ca，P，Na
E. 维生素A、维生素D、B族维生素

正确答案：D。Ca，P，Na